水逆呕吐的特点是
A. 吐势徐缓，吐物清稀
B. 呕吐黏稠苦水
C. 口干欲饮，饮后则吐
D. 喷射状呕吐
E. 朝食暮吐，暮食朝吐

正确答案：C。口干欲饮，饮后则吐

解析：水逆呕吐的特点是口干欲饮，饮后则吐者，多因饮邪停胃，胃气上逆所致（C对）。吐势徐缓，声音微弱，呕吐物清稀者，多属虚寒证。常因脾胃阳虚，脾失健运，胃失和降，胃气上逆所致（A错）。吐势较猛，声音壮厉，呕吐出黏稠黄水，或酸或苦者，多属实热证。常因邪热犯胃，胃失和降，胃气上逆所致（B错）。呕吐呈喷射状者，多为热扰神明，或因头颅外伤，或因脑髓有病等（D错）。朝食暮吐、暮食朝吐者，为胃反，多属脾胃阳虚证（E错）。